香豆素类灭鼠药中毒的特效解毒剂是
A. 乙酰胺
B. 维生素B₆
C. 阿托品
D. 维生素K₁
E. 普萘洛尔

正确答案：D。维生素K₁

解析：本题考查香豆素类杀鼠药中毒解救。香豆素类灭鼠药中毒的特效解毒剂是维生素K₁（D对）。香豆素类灭鼠药中毒的特效解毒剂：静脉滴注维生素K₁10～30mg, 一日1～3次；亦可先静脉注射维生素K₁50mg ，然后改为10～20mg肌内注射，一日1～4次。严重出血时每日总量可用至300mg。维生素K₃、维生素K₄无效。乙酰胺（A错）是氟乙酰胺的特效解毒剂。维生素B₆（B错）可用于乙醇中毒的解救。阿托品（C错）可用于有机磷中毒的解救。普萘洛尔（E错）可用于瘦肉精重度中毒的解救。